不符合Ⅲ房室传导阻滞心电图特征的是
A. R-R间期相等
B. QRS波群形态可正常，也可呈宽大畸形
C. 心房率<心室率
D. 心房率>心室率
E. P-P间期相等

正确答案：C。心房率<心室率

解析：Ⅲ房室传导阻滞心电图特点为1.心房率大于心室率（D对）（C错，为本题正确答案），即P波频率高于QRS波群频率。心室由逸搏心律控制。QRS波群形态取决干异位起搏点位置的高低；交界性逸搏心律的起搏点位于希氏束分叉以上，QRS波群形态正常，心室率常为40～60次/min；2.房室分离，当心房由窦房结控制时，可见P波规则出现，P波与QRS波群无固定关系，P间期与RR间期各有其固定的规律性（AE对）。3.室性逸搏心律的起搏点位于希氏束分叉以下，QRS波群宽大、畸形，心室率常在40次/min以下（B对）。